医师张某，因嫌弃在医院工作工资太少，从医院辞职后从事医药销售工作已有二年，有关卫生行政部门应对其作如何处理
A. 处以罚款3000元
B. 注销注册，收回医师执业证书
C. 处以罚款l万元以上
D. 令其在规定期限内回医院工作
E. 以上都不对

正确答案：B。注销注册，收回医师执业证书

解析：该医师从医院辞职后从事医药销售工作已有二年，属于中止医师执业活动满2年，有关卫生行政部门应注销注册，收回医师执业证书（B对）。